三七伪品菊科“土三七”的鉴别特征有
A. 呈拳形团块，全体有瘤状突起
B. 切面淡黄色
C. 味苦而回甜
D. 横切面中心有显著的髓部
E. 含草酸钙簇晶

正确答案：A、B、D、E。呈拳形团块，全体有瘤状突起；切面淡黄色；横切面中心有显著的髓部；含草酸钙簇晶

解析：本题考查的是三七伪品的性状鉴别。三七伪品菊科“土三七”的鉴别特征有呈拳形团块，全体有瘤状突起（A对）、切面淡黄色（B对）、横切面中心有显著的髓部（D对）、含草酸钙簇晶（E对）。菊三七为菊科植物的根茎，又称为土三七或血三七，呈拳块状，表面灰棕色或棕黄色，全体有瘤状突起，质地坚实，断面中心疏松或有时中空；藤三七为落葵科植物的块茎，呈不规则块状，断面粉性，味微甜，嚼之有黏性；景天三七为景天科植物的根和根茎，有时也以全草入药，全草可见茎圆形，青绿色，易折断，断面中空，叶多脱落，残留叶皱缩或破碎。块根数条，粗细不均，表面灰棕色，质硬而脆，断面暗棕色或类灰白色。支根圆柱形或略带圆锥形，表面呈剥裂状。断面颜色：土三七的断面颜色为淡黄色。